下列具有广谱抗菌作用，可降低双歧杆菌三联活菌肠溶胶襄、乳酶生片等活菌类制剂药效的中药有
A. 金银花
B. 连翘
C. 黄芩
D. 鱼腥草
E. 麻黄

正确答案：A、B、C、D。金银花；连翘；黄芩；鱼腥草

解析：本题考查化学药与中药的联合应用。金银花（A对）、连翘（B对）、黄芩（C对）、鱼腥草（D对）等及其中成药不宜与乳酶生、培菲康（双歧杆菌三联活菌复方制剂）等活菌类制剂联用，因前者可降低后者的制剂活性。蜂蜜、饴糖等含糖较多的中药及其制剂，不可与胰岛素、格列本脲等降糖药同用，以免影响药效。